女性，28岁，牙龈刷牙出血2年。检查：全口牙石（+），牙龈缘轻度红肿，探诊出血，探诊深度2mm，未见牙龈退缩。如果5个月后，该患者再来就诊时，牙龈出血明显，牙龈呈鲜红色，松软光亮，肥大，轻探易出血。此时应考虑到的最可能的诊断是
A. 慢性龈炎
B. 妊娠期龈炎
C. 坏死性龈炎
D. 慢性牙周炎
E. 侵袭性牙周炎

正确答案：B。妊娠期龈炎

解析：本题考查妊娠期龈炎的诊断。慢性龈炎治疗后可恢复正常，5个月后再出现的症状和表现与原来不同，妊娠期龈炎（B对）可发生于个别牙龈或全口的牙龈，以前牙区为重。龈缘和龈乳头呈鲜红或暗红色，松软而光亮，或呈现显著的炎性肿胀、肥大，有龈袋形成，轻触之即易出血，患者吮吸或进食时也易出血，此常为就诊时的主诉症状。一般无疼痛，严重时龈缘可有溃疡和假膜形成，此时可有轻度疼痛。